要想影响上皮细胞的连接和营养，浸润的白细胞需要达到结合上皮体积的
A. 0.2
B. 0.3
C. 0.4
D. 0.5
E. 0.6

正确答案：E。0.6

解析：本题考查牙周袋形成的机制。要想影响上皮细胞的连接和营养，浸润的白细胞需要达到结合上皮体积的60%（E对）。当入侵的白细胞达到结合上皮体积60%以上时，影响上皮细胞的连接和营养，靠近冠方的结合上皮即从牙面剥离，使龈沟底移向根方而形成牙周袋。牙周袋的形成始于牙龈结缔组织中的炎症以及炎症所引起的胶原纤维破坏和结合上皮的根方增殖，牙周袋的最初加深发生在结合上皮与牙面之间或结合上皮内。